女，32岁，认为有社会组织跟踪她，总觉得有人要投毒害她，并且在吃的饭里下毒，在家里的门都加锁，害怕有人害她，所有人都在背后议论她，还有人跟踪监视她，该女子考虑什么疾病
A. 精神分裂症
B. 躁狂症
C. 被迫妄想症
D. 双相障碍
E. 分离障碍

正确答案：A。精神分裂症

解析：女，32岁，认为有社会组织跟踪她，总觉得有人要投毒害她，并且在吃的饭里下毒，在家里的门都加锁，害怕有人害她，所有人都在背后议论她，还有人跟踪监视她，结合患者的表现，提示为提示被害妄想症表现，属于精神分裂症。精神分裂症：出现幻觉，妄想，存在思维形式障碍按严重程度由轻到重可表现为病理性赘述、思维散漫离题、思维破裂及词的杂拌（A对）。（P123）躁狂发作的典型临床表现是情感高涨、思维奔逸、活动增多“三高＂症状，可伴有夸大观念或妄想、冲动行为等。发作应至少持续一周，并有不同程度的社会功能损害，可给自己或他人造成危险或不良后果（B错）。（P120）双相障碍（BPD）也称双相情感障碍，是指临床上既有躁狂或轻躁狂发作，又有抑郁发作的一类心境障碍。双相障碍一般呈发作性病程，躁狂和抑郁常反复循环或交替出现，也可以混合方式存在，每次发作症状往往待续一段时间，并对患者的日常生活和社会功能等产生不良影响（D错）。（P152）分离障碍则是一类复杂的心理生理紊乱过程患者非自主地、间断地丧失部分或全部心理生理功能的整合能力，在感知觉、记忆情感、行为、自我（身份）意识及环境意识等方面的失整合，即所谓的分离状态，如自我身份不连续、不能用病理生理性解释的记忆丧失、躯体功能障碍而相应生理无改变等（E错）。